麻黄配桂枝属于
A. 相使
B. 相杀
C. 相恶
D. 相须
E. 相反

正确答案：D。相须

解析：相须是两种性能功效类似的中药配合应用，可以增强原有药物的功效。麻黄配桂枝属于相须为用，两者相配可增强发汗解表，祛风散寒的作用（D对）。相使是在性能功效方面有某些共性，其中以一种中药为主，另一种中药为辅，两药合用，辅药可以提高主药的功效（A错）。相杀是一种中药能够降低或消除另一种中药的毒性或副作用（B错）。相恶即两药合用，一种中药能使另一种中药原有功效降低，甚至丧失（C错）。相反是两种中药同用能产生或增强毒性或副作用（E错）。